循证药物信息中，“缺乏证据支持，证据来自专家委员会的报告”，其证据等级应是
A. A
B. B
C. C
D. D
E. E

正确答案：C。C

解析：本题考查循证医学中的证据等级。循证医学药物信息共分五类三级：①A类:有良好的证据支持；②B类：有较好的证据支持；③C类（C对）：缺乏证据支持；④D类：有较充实的证据反对；⑤E类：有充分证据反对。